对粮豆仓储的叙述正确的是
A. 储藏期间的代谢活动主要表现在氧化分解作用
B. 相对湿度在65%～70%可以有效地抑制真菌和细菌的生长繁殖
C. 水分含量与其加工方式无关
D. 水分含量与其储藏时间无关
E. 水分含量高时，其代谢活动减弱

正确答案：B。相对湿度在65%～70%可以有效地抑制真菌和细菌的生长繁殖

解析：本题考查粮豆仓储的相关内容。在储藏期间粮豆的代谢活动主要表现在呼吸作用和后熟作用（A错），水分含量的高低与其储藏时间的长短（D错）和加工方式密切相关（C错）。粮豆水分含量过高时，其代谢活动增强（E错）而发热，真菌、仓虫易生长繁殖，使粮豆发生据变，因此，应将粮豆水分含量控制在安全水分以下。一般来说，相对湿度在65%～70%可以有效地抑制真菌、细菌和仓储害虫的生长繁殖（B对）。